十二经脉的别络都是从
A. 胸背部分出
B. 头面部分出
C. 四肢肘膝以下分出
D. 四肢肘膝以上分出
E. 四肢末端分出

正确答案：C。四肢肘膝以下分出

解析：该题主要考察十五别络的循行特点。十二经脉的别络均从肘膝关节以下分出（C对），走向相表里的经脉，与其络相通，则阴经的别络可络于阳经，阳经的别络络于阴经。